会阴骑跨伤后尿道损伤部位
A. 尿道全部
B. 阴茎部
C. 前列腺部
D. 尿道膜部损伤
E. 尿道球部

正确答案：E。尿道球部

解析：会阴骑跨伤后排尿困难，尿道滴血，损伤部位主要为尿道球部（E对）。